男，30岁，乏力咳嗽1月余，伴低热盗汗痰中带血1周，胸片示：右肺上叶尖段炎症，伴有空洞形成。最可能的诊断是
A. 肺囊肿继发感染
B. 浸润型肺结核
C. 慢性肺脓肿
D. 癌性空洞伴感染
E. 金黄色葡萄球菌肺炎

正确答案：B。浸润型肺结核

解析：患者为青年男性，咳嗽1月余，痰中带血，伴有乏力、低热和盗汗（为肺结核的典型临床表现），可初步判断为结核病，根据胸片提示右肺上叶尖段炎症，伴有空洞形成，则最可能的诊断为浸润型肺结核（B对）。肺囊肿（A错）的胸片表现为肺部透亮区，壁薄，无液平面，继发感染时囊肿内可见气液平面，周围炎症反应轻，无低热盗汗等结核中毒症状，所以该患者不诊断为肺囊肿继发感染。慢性肺脓肿（C错）的患者常有咳嗽、咳脓痰、反复发热和咳血，持续数周到数月，X线可见脓腔壁增厚，内壁不规则，有时呈多房性，周围有纤维组织增生和胸膜增厚，与该患者的表现不同。癌性空洞伴感染（D错）多见于老年人且有吸烟史，表现为刺激性咳嗽，痰中带血，胸痛和消瘦等，X线胸片可见偏心厚壁空洞。金黄色葡萄球菌肺炎（E错）临床表现为起病急，高热，痰脓性，量多，带血丝或呈脓血状，毒血症状明显，全身肌肉、关节酸痛，X线表现为肺叶或肺段实变，早期偶可形成空洞。